下列哪项症状不属苓桂术甘汤所治
A. 目眩
B. 短气
C. 胸胁支满
D. 脐下有悸
E. 小便不利

正确答案：D。脐下有悸

解析：心下，即胃之所在，故此当属狭义痰饮证。饮停中州，阻碍气机，浊阴不降，弥漫于胸胁则支撑胀满；清阳不升，浊阴上蒙清窍则头昏目眩。病机属脾胃阳虚，痰饮中阻。治用苓桂术甘汤温阳化饮，健脾利水。方中茯苓淡渗利水。化饮降浊。为治饮病之要药，桂枝辛温通阳，振奋阳气以消饮邪，两药合用，可温阳化饮；白术健脾燥湿，甘草和中益气，两药相伍，补土制水。本方是温阳化饮的主要方剂，亦是“温药和之”的具体运用。微饮是水饮轻微者，即上文所谓“水停心下，微者短气”之证。饮邪虽轻微，但其本在脾肾之阳不化，故必须早为图治。水饮内停，妨碍气机升降则短气，气化不行则小便不利。要使气机畅达，必先除其水饮。尤在泾说：“欲引其气，必蜀其饮。”治水饮可用利小便的方法，故“当从小便去之”是本证治法。化气利小便，使气化水行，饮有去路，则短气之症自除。但饮邪的形成，有因中阳不振，不能运化水湿，水停为饮者，其本在脾，必兼见胸胁支满、头晕目眩、心下悸动等症，治宜健脾渗湿，通阳利水，方用苓桂术甘汤。茯苓桂枝甘草大枣汤可治“脐下悸者，欲作奔豚”（D错，为本题正确选项）。